从东南亚入境一男子，3天前因突然剧烈呕吐、腹泻而入院，腹泻物呈米泔水样，便检发现穿梭状运动的细菌，请问致病菌可能是
A. 副溶血孤菌
B. 肠炎杆菌
C. 鼠伤寒沙门菌
D. 产气荚膜梭菌
E. 霍乱弧菌

正确答案：E。霍乱弧菌

解析：男性患者从东南亚入境（沿海地区为霍乱弧菌流行地区），3天前因突然剧烈呕吐，腹泻而入院，腹泻物呈米泔水样（为霍乱泻吐期典型症状），便检发现穿梭状运动的细菌（动力试验阳性），根据临床症状、既往史和病原菌检查结果，致病菌可能是霍乱弧菌（E对），是霍乱的病原菌。副溶血性弧菌（A错）是进食海产品引起的食物中毒常见的病原体，烹饪不当的海产品或因食物容器污染本菌后导致食物中毒，可有腹痛、腹泻、呕吐和低热，粪便多为水样，经过治疗后，恢复较快（P127）。产气荚膜梭菌（D错）引起的食物中毒为食入被大量细菌繁殖体污染的食物（主要为肉类食品）而引起，表现为腹痛、腹胀、水样腹泻，无发热无恶心呕吐，1～2天可自愈（P135）。鼠伤寒沙门菌（C错）导致的食物中毒为摄入大量被细菌污染的食品引起，常见的食物主要为畜、禽类的肉食品，其次为蛋、奶食品，系动物生前感染剧加工处理过程污染所致，起病急，临床症状主要为发热、恶寒、呕吐、腹痛、水样腹泻，偶有黏液或脓性腹泻，严重者可伴有迅速脱水，导致休克、肾衰竭而死亡（P119）。肠炎杆菌（B错）的说法不准确。